不属于痈的疾病是
A. 颈痈
B. 脐痈
C. 腋痈
D. 锁喉痈
E. 委中毒

正确答案：D。锁喉痈

解析：急性蜂窝织炎是指发生于皮下、筋膜下、肌间隙或深部蜂窝组织的急性细菌感染。中医学称之为“发”。古籍上的“锁喉痈”“臀痈”虽命名为痈，其实属“发”的范畴（D对）。一般痈发无定处，随处可见，因发病部位不同，名称繁多，如生于颈部的颈痈（A错），生于脐部的脐痈（B错），生于腋下的腋痈（C错），生于委中穴的委中毒（E错）。